Bishop宫颈成熟度评分得2分的是
A. 宫口开大4cm
B. 先露位置-2
C. 宫颈管消退80%
D. 宫口位置后方
E. 宫颈中等硬度

正确答案：A。宫口开大4cm

解析：Bishop宫颈成熟度评分得2分的有宫口开大3～4cm（A对）、宫颈管消退60％～70％（C错）、先露位置﹣1～0（B错）、宫颈软（E错）、宫口位置前方（D错）。